治疗慢性肝炎肝郁气滞证，应首选
A. 茵陈蒿汤
B. 逍遥散
C. 一贯煎
D. 膈下逐瘀汤
E. 龙胆泻肝汤

正确答案：B。逍遥散

解析：逍遥散（B对）具有疏肝解郁，健脾和中的功效，常用于因肝郁气滞，脾失运化而致的慢性肝炎肝郁脾虚证，症见胁肋胀满，精神抑郁或性情急躁，面色萎黄，大便溏薄，食少，口淡乏味，脘腹痞胀，舌质淡红，苔白，脉沉弦。茵陈蒿汤（A错）具有清热利湿解毒的功效，常用于慢性肝炎湿热中阻证；一贯煎（C错）具有养血柔肝、滋阴补肾的功效，常用于慢性肝炎肝肾阴虚证；膈下逐瘀汤（D错）具有活血化瘀、通络散结的功效，常用于慢性肝炎瘀血阻络证；龙胆泻肝汤（E错）具有清泻肝胆实火、清利肝经湿热的功效，主治肝胆实火上炎证及肝经湿热下注证。